设立产生职业病危害的用人单位，其工作场所还应当符合下列职业卫生要求，但除外
A. 职业病危害因素的强度或者浓度符合国家职业卫生标准
B. 有与职业病危害防护相适应的设施
C. 生产布局合理，符合有害与无害作业分开的原则
D. 制定职业病防治计划和实施方案
E. 设备、工具、用具等设施符合保护劳动者生理，心理健康的要求

正确答案：D。制定职业病防治计划和实施方案